黄骨髓位于
A. 幼儿长骨骨干的内部
B. 幼儿长骨骨骺内部
C. 成人长骨骨干的内部
D. 成人扁骨内部
E. 所有骨的内部

正确答案：C。成人长骨骨干的内部

解析：5 岁以后，长骨骨干内的红骨髓逐渐被脂肪组织代替，呈黄色，称黄骨髓（C对）。胎儿和幼儿的骨髓均为红骨髓，椎骨、骼骨、肋骨、胸骨以及肱骨和股骨等长骨的骺内终生存在红骨髓（A错）。